吴茱萸具有散寒止痛作用，主要用于治疗的病证是
A. 寒凝肝脉之寒疝腹痛
B. 胸阳痹阻之胸痹痛
C. 脾胃虚寒之脘腹冷痛
D. 肝郁气滞之胁肋胀痛
E. 寒湿阻络之肢体冷痛

正确答案：A。寒凝肝脉之寒疝腹痛

解析：吴茱萸辛散苦泄，性热祛寒，主入肝经，既散肝经之寒邪，又疏肝气之郁滞，为治肝寒气滞诸痛之主药，如寒疝腹痛（A对）。